二期处理火器伤延期缝合应在清创处理后的
A. 12小时～1天
B. 2～3天
C. 4～7天
D. 8～14天
E. 14天以后

正确答案：C。4～7天